某12岁男孩，急性发热，腰痛，查体：眼睑水肿，血压145/100mmHg，尿检含一定数量红细胞，尿蛋白阳性，诊断为急性肾小球肾炎。患者出现血尿和蛋白尿的主要原因是
A. 肾小球毛细血管血压升高
B. 肾小球滤过膜面积增大
C. 肾小球滤过膜通透性增大
D. 肾小管重吸收的减少
E. 肾小管排泄功能的下降

正确答案：C。肾小球滤过膜通透性增大